引起子痫抽搐的主要病理原因是
A. 颅内脑组织散在出血点
B. 颅内小动脉痉挛，脑水肿
C. 血钙低下
D. 代谢性酸中毒
E. 胎盘毒素

正确答案：B。颅内小动脉痉挛，脑水肿

解析：子痫是由全身小动脉痉挛、组织缺氧、微循环障碍，血管通透性增加、脑水肿、颅内高压等而导致的昏迷、呕吐、抽搐。掌握“娠期高血压疾病”知识点。